典型的坏血病是由下列何种物质缺乏而引起的
A. 核黄素
B. 泛酸
C. 硫胺素
D. 维生素K
E. 维生素C

正确答案：E。维生素C

解析：维生素C缺乏可引起坏血病（维生素C缺乏病）。掌握“水溶性维生素”知识点。